胚胎性肿瘤是
A. 癌
B. 肉瘤
C. 母细胞瘤
D. 精原细胞瘤
E. 霍奇金病

正确答案：C。母细胞瘤

解析：胚胎性肿瘤是指有些形态类似发育过程中的某种幼稚细胞或组织的肿瘤，常称为母细胞瘤（C对），如髓母细胞瘤、神经母细胞瘤等。癌（P84）（A错）是起源于上皮组织的恶性肿瘤。肉瘤（P84）（B错）是起源于间叶组织的恶性肿瘤。精原细胞瘤（P298）（D错）是发生在睾丸的无性细胞瘤。霍奇金病（P224）（E错）即霍奇金淋巴瘤，是起源于生发中心B淋巴细胞及其衍生细胞的肿瘤。